表示减毒的配伍关系是
A. 相畏
B. 相须
C. 相反
D. 相使
E. 相恶

正确答案：A。相畏

解析：本题考查的是七情配伍的内容。表示减效的配伍关系是相畏（A对）。“七情配伍”，又称配伍七情、药物七情。即指单味中药配伍同用的七种情形。除“单行”外，皆从双元配伍用药角度，论述单味中药通过简单配伍后的性效变化规律。①单行：即应用单味药就能发挥预期治疗效果，不需其他药的辅助。②相须（B错）：即性能相类似的药物合用，可增强原有疗效。③相使（D错）：即性能功效有某种共性的两药同用，一药为主，一药为辅，辅药能增强主药的疗效。④相畏：即一种药物的毒烈之性，能被另一种药物减轻或消除。⑤相杀：即一种药物能减轻或消除另一种药物的毒烈之性。⑥相恶（E错）：即两药合用，一种药物能使另一种药物原有功效降低，甚至丧失。⑦相反（C错）：即两种药物合用，能产生或增强毒害反应。